在众多的环境致癌因素中，化学性致癌因素约占
A. 0.6
B. 0.7
C. 0.8
D. 0.9

正确答案：D。0.9

解析：本题考查化学性致癌因素比例。在众多的环境致癌因素中，化学性致癌因素约占90%（D对ABC错）。